皮质核束支配
A. 脑干双侧内脏运动神经核
B. 脑干双侧一般躯体运动神经核
C. 脑干对侧特殊内脏运动神经核
D. 脑干对侧一般躯体运动神经核
E. 以上都不是

正确答案：E。以上都不是

解析：皮质核束主要由中央前回下部的锥体细胞的轴突集合而成，下行经内囊膝至大脑脚底中3/5的内侧部，由此向下陆续分出纤维，终止于双侧（CD错）脑神经运动核（AB错）。A、B、C、D选项均不完全等同于双侧脑神经运动核的概念，故E为本题正确答案。